土壤的净化作用包括
A. 物理净化、化学净化、生物净化
B. 物理净化、化学净化、光学净化
C. 物理净化、生物净化、自然净化
D. 化学净化、生物净化、自然风化
E. 物理净化、生物净化、天然净化

正确答案：A。物理净化、化学净化、生物净化

解析：本题考查土壤的净化作用。土壤的净化作用包括：1.物理净化：土壤是一个多相的疏松多孔体，进入土壤的难溶性固体污染物可被土壤机械阻留；可溶性污染物可被土壤水分稀释，降低毒性，或被土壤固相表面吸附，但可随水迁移至地表水或地下水；某些污染物可挥发或转化成气态物质通过土壤孔隙迁移到大气环境中；2.化学净化：污染物进入土壤后，可发生一系列化学反应，如凝聚与沉淀反应、氧化还原反应、络合-赘合反应、酸碱中和反应、水解、分解化合反应，或者发生由太阳辐射能和紫外线等引起的光化学降解作用等。通过上述化学反应使污染物分解为无毒物质或营养物质；3.生物净化（A对BCDE错）：土壤中存在大量依靠有机物生存的微生物，它们具有氧化分解有机物的巨大能力，是土壤自净作用中最重要的因素之一。各种有机污染物在不同条件下分解的产物多种多样，并最终转化为对生物无毒的物质。